引起牙髓感染最常见的原因是
A. 外伤
B. 牙周炎
C. 血源感染
D. 龋病
E. 牙体发育畸形

正确答案：D。龋病

解析：本题考查牙髓的感染途径。引起牙髓感染最常见的原因是龋病（D对），细菌在感染牙髓之前，其毒性产物可通过牙本质小管引发牙髓炎症反应。外伤可引起牙髓直接暴露于口腔环境，使细菌直接侵入牙髓，但较少见（A错）。牙周炎可引起逆行性牙髓炎，患者一般有严重的牙周病，临床上少见（B错）。血源感染指受过损伤或病变的牙髓组织能将血流中的细菌吸引自身所在位置，引起牙髓感染，这种感染方式一般在机体发生菌血症或败血症时出现（C错）。牙体发育畸形引起的感染存在于畸形牙齿（E错）。